可用于治疗肝昏迷，但不能改善肝功能的药物是
A. 金刚烷胺
B. 左旋多巴
C. 卡比多巴
D. 苯海索
E. 司来吉兰

正确答案：B。左旋多巴